不属于B细胞淋巴瘤的是
A. 边缘区淋巴瘤
B. 滤泡性淋巴瘤
C. 套细胞淋巴瘤
D. 间变大细胞淋巴瘤
E. Brukitt淋巴瘤

正确答案：D。间变大细胞淋巴瘤

解析：边缘区、滤泡性、套细胞及Burkitt淋巴瘤均属于B细胞淋巴瘤。间变大细胞淋巴瘤属于T细胞淋巴瘤。掌握“淋巴瘤”知识点。